用于防止复燃与传播及预防疟疾的药物是
A. 奎宁
B. 羟氯喹
C. 伯氨喹
D. 阿莫地喹
E. 青蒿素

正确答案：C。伯氨喹

解析：本题考查伯氨喹。用于防止复燃与传播及预防疟疾的药物是伯氨喹（C对）。根据作用环节，抗疟药主要分以下几类：1.主要用于控制疟疾症状的抗疟药：羟氯喹（B错）、青蒿素（E错）及其衍生物、奎宁（A错）、阿莫地喹（D错）、甲氟喹、咯萘啶、本芴醇。2.主要用于控制疟疾复发和传播的抗疟药：伯氨喹。3.主要用于疟疾预防的抗疟药：乙胺嘧啶、磺胺类。